纯阳温散，长于引火归元的药是
A. 仙茅
B. 肉桂
C. 丁香
D. 花椒
E. 高良姜

正确答案：B。肉桂

解析：本题考查的是肉桂的性能特点。纯阳温散，长于引火归元的药是肉桂（B对）。肉桂：【性能特点】本品辛甘而热，温补行散，气厚纯阳。入肾经，缓补肾阳而补火助阳或引火归元。入肝、心、脾经，消沉寒痼冷而散寒止痛；温通经脉而活血散瘀。助阳不及附子，回阳救逆一般不用。长于益阳消阴、缓补肾阳与引火归元，亦为补火助阳之要药；又入血分，善温通经脉，改善微循环，血瘀有寒者宜用。仙茅（A错）：【性能特点】本品辛热燥散，力强有毒，入肾、肝、脾经。善温肾壮阳，治肾虚阳痿、精冷。能强筋健骨、祛寒除湿，疗寒湿久痹、阳虚冷泻。丁香（C错）：【性能特点】本品辛香温散沉降，药力较强。入脾、胃经，善温中降逆，治中寒呃逆；入肾经，能温肾助阳，治肾阳虚诸证；脾肾虚寒呃逆用之更佳。花椒（D错）：【性能特点】本品辛热燥散，有小毒，力较强，入脾、胃、肾经。善温中散寒而止痛，并兼燥湿，治中寒腹痛吐泻；能杀虫，治虫积腹痛及湿疹阴痒。高良姜（E错）：【性能特点】本品辛热燥散，入脾、胃经。善温中散寒而止痛、止呕、止泻，为治中寒腹痛吐泻之要药。